孕妇，30岁。主诉乏力，易倦，检查血红蛋白低于正常。则应该补充的物质是
A. 蔬菜，水果
B. 豆浆，牛奶
C. 淀粉类主食
D. 含钙多的物质
E. 猪肝，肉类

正确答案：E。猪肝，肉类

解析：该孕妇，主诉乏力，易倦，检查血红蛋白低于正常，诊断为贫血，应进食含铁丰富的食物，如猪肝（E对）、鸡血、豆类。蔬菜，水果（A错）；豆浆，牛奶（B错）；淀粉类主食（C错）；含钙多的物质（D错）含铁均较猪肝，肉类少。